致肺脏间皮瘤的粉尘是
A. 石棉尘
B. 铬酸盐尘
C. 二氧化硅尘
D. 水泥尘
E. 木粉

正确答案：A。石棉尘

解析：本题考查肺脏间皮瘤的诱因。间皮瘤分良性和恶性两类，石棉（A对BCDE错）接触与恶性间皮瘤有关，间皮瘤可发生于胸、腹膜，以胸膜最多见。恶性间皮瘤发生与接触石棉类型有关，致恶性间皮瘤最强的为青石棉。石棉具有较强的致恶性间皮瘤潜能，可能与其纤维性状和多丝结构，容易断裂成巨大数量的微小纤维富集于胸膜有关。